易感但内向、稳重、持久但懦弱，沉默而孤独是哪种人的气质特征
A. 胆汁质
B. 多血质
C. 黏液质
D. 抑郁质
E. 其他

正确答案：D。抑郁质